对于半衰期长的药物，要迅速达到稳态血药浓度可采用的给药方法是
A. 等剂量等间隔给药
B. 首次给药剂量加倍
C. 恒速静脉滴注
D. 增加给药频率
E. 隔日给药

正确答案：B。首次给药剂量加倍

解析：本题考查单室模型静脉滴注给药。对于半衰期长的药物，使血药浓度迅速达到或者接近稳态血药浓度（Css）可以首次给药剂量加倍（B对），随后改用静脉滴注来维持该浓度。